既能泻下逐水，又能去积杀虫的药物是
A. 槟榔
B. 甘遂
C. 使君子
D. 牵牛子
E. 京大戟

正确答案：D。牵牛子

解析：该题考查牵牛子的功效，属记忆内容。牵牛子性苦寒，归肺、肾、大肠经。其功效为泻下逐水，去积杀虫（D对）。